患者，男，25岁。1天前进食不洁瓜果后出现腹痛、腹胀，下痢脓血，里急后重，舌质略红，苔黄，脉数。治疗宜用黄连配伍下列哪味药效果更佳
A. 黄芩
B. 黄柏
C. 木香
D. 苦参
E. 香附

正确答案：C。木香

解析：患者出现腹痛、腹胀、下痢脓血，里急后重，舌红，苔黄，脉数，为湿热痢疾的表现，除用黄连清热燥湿外，还应用木香行气化滞（C对）。黄芩（A错）的功效是清热燥湿，泻火解毒，止血，安胎。黄柏（B错）的功效是清热燥湿，泻火除蒸，解毒疗疮。苦参（C错）的功效是清热燥湿，杀虫利尿。香附（E错）的功效是疏肝解郁，理气宽中，调经止痛。